马拉硫磷可以增强米硫磷的毒性，体现了
A. 相加作用
B. 协同作用
C. 拮抗作用
D. 独立作用
E. 以上均不是

正确答案：B。协同作用